卫生服务需要主要取决于卫生服务消费者的
A. 实际支付能力
B. 购买愿望
C. 购买愿望和支付能力
D. 自身健康状况
E. 健康状况和购买愿望

正确答案：D。自身健康状况

解析：卫生服务需要主要取决于居民的自身健康状况，即取决于消费者的自身健康状况（D对）。消费者的购买愿望（BCE错）和消费者的支付能力（AC错）均为卫生服务需求形成必须具备的条件。